我国的绝大部分领土在北纬45°地区，居室最适宜的朝向是
A. 坐北朝南
B. 东西向
C. 西南向
D. 东北向
E. 坐南朝北

正确答案：A。坐北朝南

解析：本题考查居室最适宜的朝向。我国的绝大部分领土在北纬45°地区，居室最适宜的朝向是坐北朝南（A对BCDE错）。这样的设计可使居室能满足在冬季得到尽最多的日照，夏季能避免过多的日照和有利于自然通风的要求。